炙甘草汤的功用是
A. 渗湿
B. 通便
C. 升阳
D. 补血
E. 疏肝

正确答案：D。补血

解析：本题考查炙甘草汤的功用，属记忆内容。炙甘草汤的功用益气滋阴，通阳复脉，主治阴血阳气虚弱，心脉失养证和虚劳肺痿。因本方为阴阳气血并补之剂，所以（D对）。炙甘草汤主治：1.阴血阳气虚弱，心脉失养证 2.虚劳肺痿证（ABCE错）。